患者，女，42岁。心悸气短，动则气促，神疲乏力，自汗，胸闷心痛，咳唾痰涎，舌暗红苔白腻，脉弦滑时有结代。诊断为风心病，心功能3级。其治法是
A. 益气通瘀化痰
B. 益气温阳化瘀
C. 益气温阳祛痰
D. 温阳泻肺逐饮
E. 温阳活血利水

正确答案：A。益气通瘀化痰

解析：心主血脉，心脉瘀阻，心失所养，故心悸气短，动则气促；气虚则神疲乏力，自汗；血瘀气滞，心阳被遏，则胸闷心痛；舌暗红苔白腻，脉弦滑时有结代均为气滞血瘀的表现。故治疗需益气通瘀化痰（A对）。方药选用独参汤合桃仁红花煎加减（BCDE错）。